体育锻炼能促进哪些器官组织的发育
A. 心肺功能
B. 神经精神发育
C. 全面促进身体发育
D. 免疫系统
E. 骨骼系统

正确答案：C。全面促进身体发育

解析：本题考查体育锻炼的相关内容。体育锻炼能全面促进身体发育（C对ABDE错）。体育锻炼能改善神经系统的调节功能，使人体适应内外环境的变化、保持肌体生命活动的正常进行，有利于人体骨骼、肌肉的生长，增强心肺功能，改善血液循环系统、呼吸系统、消化系统的机能状况，有利于人体的生长发育，提高抗病能力，增强有机体的适应能力，减低儿童在成年后患上心脏病、高血压、糖尿病等疾病的机会。还可以陶冶情操，保持健康的心态，具有调节人体紧张情绪的作用，能改善生理和心理状态。